抑郁症患者连续服用丙米嗪后，出现较轻的
A. 安静
B. 血压稍降
C. 思睡
D. 精神振奋
E. 抑郁

正确答案：D。精神振奋

解析：丙米嗪对中枢神经系统的作用：正常人服用后出现安静、思睡、血压稍降等以及抗胆碱反应。但抑郁症患者连续服药后，出现精神振奋现象，症状较轻。掌握“丙米嗪、碳酸锂、氟西汀”知识点。